欧盟负责食品安全风险评估的机构是
A. 欧洲理事会
B. 欧盟委员会
C. 欧洲食品安全局
D. 食品与兽医办公室
E. 健康与消费者保护总署

正确答案：C。欧洲食品安全局

解析：本题考查欧盟负责食品安全风险评估的机构。欧盟负责食品安全风险评估的机构是欧洲食品安全局（EFSA）（C对ABDE错）。